具有散寒止痛，疏肝下气，燥湿，通阳止泻功效的药物是
A. 附子
B. 肉桂
C. 干姜
D. 吴茱萸
E. 高良姜

正确答案：D。吴茱萸

解析：吴茱萸的功效是散寒止痛，降逆止呕，助阳止泻；本品辛热燥烈，又能燥湿（D对）。附子（A错）的功效是回阳救逆，补火助阳，散寒止痛。肉桂（B错）的功效是补火助阳，散寒止痛，温通经脉，引火归元。干姜（C错）的功效是温中散寒，回阳通脉，温肺化饮。高良姜（E错）的功效是温胃止呕，散寒止痛。